风痰的特征是
A. 色黄黏稠
B. 白而清稀
C. 清稀多泡沫
D. 白滑而量多
E. 少而黏稠

正确答案：C。清稀多泡沫

解析：风痰证是指痰盛而风动的证候。多由阴虚阳亢，风胜内动夹痰，或偏食甘肥厚味，痰涎壅盛所致。主要临床表现：头晕目眩，胸胁满闷，喉中痰呜，痰清而多泡，突然仆倒，或见口眼歪斜，舌强不语，四肢麻木，偏瘫，舌红苔腻，脉弦细滑。（C对）。痰黄质稠（A错），甚则结块者，多属热痰。因邪热犯肺，煎津为痰，痰聚于肺所致。痰白质清稀（B错）者，多属寒痰。因寒邪阻肺，津凝不化，聚而为痰，或脾阳不足，湿聚为痰，上犯于肺所致。痰少而质黏（E错），难于咯出者，多属燥痰。因燥邪犯肺，耗伤肺津，或肺阴虚津亏，清肃失职所致。痰白质滑量多（D错），易于咯出者，多属湿痰。因脾失健运，水湿内停，湿聚为痰，上犯于肺所致。